心理咨询的基本手段不包括
A. 宣泄
B. 领悟
C. 帮助选择和决定
D. 强化自我控制
E. 增强自信心

正确答案：C。帮助选择和决定